男，32岁。咽痛、咳嗽7天，水肿、伴尿少5天。化验：Hb90g/L，尿蛋白（+++），血肌酐500umol/L，血尿素氮23mmol/L，B超示双肾增大。其最可能的临床诊断是
A. 肾病综合征
B. 慢性肾小球肾炎
C. 急性肾小球肾炎
D. 急性肾盂肾炎
E. 急进性肾小球肾炎

正确答案：E。急进性肾小球肾炎

解析：中年男性患者，咽痛咳嗽7天（上呼吸道感染史），有蛋白尿、水肿、贫血等临床症状，且血肌酐500umol/L 【正常值（女）70-108μmol/L，提示患者肾功能衰竭】，血尿素氮23mmol/L（正常值2.86-7.14mmol/L，提示患者肾功能受损），应诊断为急进性肾小球肾炎（E对）。肾病综合征（A错）特征：大量蛋白尿、水肿、低蛋白血症（P470）。慢性肾小球肾炎（B错）起病缓慢，隐袭，病程需长达3月以上才可确诊（P478）。急性肾小球肾炎（C错）常于链球菌感染后1～3周发生血尿、蛋白尿、水肿和高血压，肾功能可一过性受损，表现为血肌酐轻度增高（P466），本病患者患者1周内即进入肾功能衰竭期，可排除该诊断。慢性肾盂肾炎（D错）多有反复发作的泌尿系统感染史，表现为发作性的寒战，发热，腰背痛（肋脊角处有明显的叩击痛），通常还伴有腹部绞痛，恶心，呕吐，尿痛，尿频和夜尿增多，尿沉渣中常有白细胞（P493）。